重复染毒引起毒作用的关键因素是
A. 暴露时间
B. 暴露频率
C. 接触时间
D. 接触频率

正确答案：B。暴露频率

解析：本题考查重复染毒引起毒作用的关键因素。重复染毒引起毒作用的关键因素是暴露频率（B对ACD错）。如果化学物在体内暴露频率间隔时间短于其生物半衰期，可引起严重的毒作用；若机体对毒作用损害恢复的间隔时间不够，则可能发生慢性毒作用。